十二指肠球溃疡腹痛规律是
A. 持续性腹痛
B. 疼痛-排便-加重
C. 进食-疼痛-缓解
D. 疼痛-进食-缓解
E. 疼痛-排便-缓解

正确答案：D。疼痛-进食-缓解

解析：十二指肠溃疡患者多为饥饿痛，常因进食后中和胃内过多的胃酸，减少胃酸流入十二指肠而疼痛缓解，腹痛规律是疼痛-进食-缓解（D对）。持续性腹痛（A错）不具有特异性。进食-疼痛-缓解（C错）为胃溃疡的腹痛特点。疼痛-排便-缓解（E错）为肠易激综合征的腹痛特点（P386）。疼痛-排便-加重（B错）少见。